急性心包炎时心包摩擦音的特点是
A. 在胸廓下部闻及
B. 与心搏一致
C. 吸气末明显
D. 仰卧位时最明显
E. 舒张期最明显

正确答案：B。与心搏一致

解析：心包摩擦音是指脏层与壁层心包由于生物性或理化因素致纤维蛋白沉积而粗糙，以致在心脏搏动时产生摩擦而出现的声音，在心前区或胸骨左缘第3、4肋间可以闻及（A错）；坐位前倾及呼吸末时，因心脏更贴近体表，杂音更明显（CD错）；其与心搏一致（B对）。典型者摩擦音的声音呈三相：心房收缩-心室收缩-心室舒张期，但多为心室收缩-心室舒张的双期摩擦音，收缩期最明显（E错）。